男，70岁，2周来反复胸痛，发作与劳累及情绪有关，休息可以缓解。3小时前出现持续性疼痛，进行性加剧，并有气促，不能平卧，血压110/70mmHg，心率120次/分，律齐，心尖部可闻及Ⅲ级收缩期杂音，双肺散在哮鸣音及湿啰音。该患者的诊断最可能是
A. 风心病二尖瓣关闭不全
B. 扩张型心肌病
C. 支气管哮喘
D. 支气管肺炎
E. 急性心肌梗死并发左心衰竭

正确答案：E。急性心肌梗死并发左心衰竭